膜剂的制备技术
A. 溶剂-溶融法
B. 复凝聚法
C. 饱和水溶液
D. 塑制法
E. 涂膜法

正确答案：E。涂膜法

解析：本题考查膜剂的制备方法。膜剂的制备技术为涂膜法（E对）。膜剂的制备：膜剂的制备方法国内主要采用涂膜法。固体分散体的制备方法：熔融法、溶剂法（共沉淀法或共蒸发法）、溶剂-熔融法（A错）及其他方法。微囊的制备：微囊的制备方法可分为物理化学法、物理机械法和化学法三大类。可根据药物和囊材的性质、微囊所需的粒径、释放及靶向要求，选择不同的制备方法。物理化学法：根据形成新相方法的不同，相分离法又分为单凝聚法、复凝聚法（B错）、溶剂一非溶剂法、改变温度法和液中干燥法。环糊精包合技术包合物的制备：包合物的制备常采用饱和水溶液（C错）法和研磨法。浓缩丸的制备：浓缩丸的制备方法主要有泛制法和塑制法（D错），比较常用的是塑制法。用于制备小丸（粒径0.5～3.5mm）的方法，目前发展有挤出-滚圆法、离心造丸法、流化床喷涂法等。